H₂受体阻断药临床主要用于
A. 抗过敏
B. 止吐
C. 治疗消化道溃疡
D. 镇静
E. 治疗晕动病

正确答案：C。治疗消化道溃疡